在生物等效性评价中，用于检验两种制剂AUC或Cmax间是否存在显著性差异方法是
A. 双向单侧t检验与90%置信区间
B. 系统适用性试验
C. 非参数检验法
D. 限量检查法
E. 方差分析

正确答案：E。方差分析

解析：本题考查体内药物检测。在生物等效性评价中，用于检验两种制剂AUC或Cmax间是否存在显著性差异方法是方差分析（E对）。方差分析，又称“变异数分析”或“F检验”，用于两个及两个以上样本均数差别的显著性检验。在生物等效性评价中，用于评价两种制剂AUC或Cmax间是否生物等效的方法是双向单侧t检验与90%置信区间（A错）。色谱分析做系统适用性试验（B错）主要是为了确定分析使用的色谱系统是有效的、适用的。系统适用性通常用四个参数来确定系统的适用性：分离度、柱效、重复性和拖尾因子。在生物等效性评价中，用于评价两种制剂Tmax间是否存在差异的方法是非参数检验法（C错）。限量检查法（D错）系检查药品中的杂质是否超过限量规定。